下列哪项是宫颈癌ⅠB1期的主要表现
A. 癌灶局限于宫颈（包括累及宫体）
B. 间质浸润深度≤3mm，宽度≥7mm
C. 间质浸润深度＞3mm至5mm，宽度≤7mm
D. 临床可见癌灶最大直径≤4cm
E. 临床可见癌灶最大直径＞4cm

正确答案：D。临床可见癌灶最大直径≤4cm

解析：ⅠB1：临床可见癌灶最大直径≤4cm。ⅠB2：临床可见癌灶最大直径＞4cm。掌握“宫颈癌”知识点。